能防止和逆转心肌肥厚的药物是
A. 地高辛
B. 氢氯噻嗪
C. 依那普利
D. 米力农
E. 硝普钠

正确答案：C。依那普利

解析：本题考查依那普利的作用。一般情况下，心室肥厚是指心室容量增加和压力增高。能防止和逆转心室肥厚的药物有血管紧张素转换酶抑制剂、血管紧张素Ⅱ受体阻滞剂、钙拮抗剂等。依那普利（C对）属于血管紧张素转换酶抑制剂（ACEI），其降压作用为抑制血管紧张素I转换成血管紧张素Ⅱ，同时还抑制缓激肽降解，从而扩张血管，降低血压。